男，60岁，间歇性跛行6年。下蹲时疼痛减轻，骑自行车正常。直腿抬高试验阴性。X线片示：腰椎骨质增生明显。最可能的诊断是
A. 腰椎管狭窄症
B. 腰椎间盘突出症
C. 慢性腰肌劳损
D. 棘间韧带损伤
E. 腰椎结核

正确答案：A。腰椎管狭窄症

解析：老年性患者，间歇性跛行6年，直腿抬高试验阴性（提示非腰椎间盘突出症），下蹲时疼痛减轻，骑自行车正常，X线片示腰椎骨质增生明显（可致椎管狭窄），结合患者症状、体征和影像学表现，最可能的诊断是腰椎管狭窄症（A对）。腰椎管狭窄症以神经源性间歇性跛行为主要特点。腰椎间盘突出症（P732）（B错）可出现坐骨神经痛、腰椎侧凸、直腿抬高试验阳性等典型表现。慢性腰肌劳损（P733）（C错）以无明显诱因的慢性疼痛为主要症状，直腿抬高试验阴性，X线表现不会出现腰椎骨质改变。棘间韧带损伤（P710）（D错）表现为腰痛长期不愈，以弯腰时明显，部分病人疼痛向骶部或臀部放射，不会超过膝关节。腰椎结核（P734）（E错）有结核病史或接触史，常有午后低热乏力等全身中毒症状，X线平片有明显骨破坏，受累椎间隙变窄。